关于生物学宽度的叙述正确的是
A. 龈沟底与牙槽嵴顶之间的恒定距离约2mm
B. 龈沟底与牙槽嵴顶之间的距离约2mm，其改变可反映牙周状况
C. 牙周炎时牙槽骨水平吸收，生物学宽度增大
D. 牙周萎缩时生物学宽度变小
E. 随年龄增长上皮附着根向迁移，生物学宽度变小

正确答案：A。龈沟底与牙槽嵴顶之间的恒定距离约2mm

解析：本题考查生物学宽度的定义。关于生物学宽度的叙述正确的是龈沟底与牙槽嵴顶之间的恒定距离约2mm（A对）。生物学宽度是恒定距离，不会改变，也无法反映牙周状况（BCDE错）。